女，62岁。发现右侧乳房肿块3个月，诊断为乳腺癌。发现血脂异常3年，未诊治。右乳腺癌改良根治术后第4天，感左小腿疼痛，左脚不能着地踏平。查体：T37.2℃，P86次/分，BP120/80mmHg，伤口局部无异常渗出，左小腿肿胀最可能的原因是
A. 血栓性浅静脉炎
B. 急性动脉栓塞
C. 血栓闭塞性脉管炎
D. 大隐静脉曲张
E. 深静脉血栓形成

正确答案：E。深静脉血栓形成

解析：老年女性患者，血脂异常3年，乳腺癌行右乳腺癌改良根治术（术后血液处于高凝状态；术后卧床导致下肢静脉血流缓慢，且患者血脂异常病史，故易形成静脉血栓）后4天，感左小腿疼痛，左脚不能着地踏平（下肢深静脉血栓的典型临床表现）。查体：T37.2℃（体温正常值36℃～37.3℃），P86次/分（正常值60～100次/分），BP120/80mmHg（正常值90～120/60～80mmHg），伤口局部无异常渗出，左小腿肿胀（提示静脉回流障碍）。综合该患者的病史及体查，应考虑诊断下肢深静脉血栓形成，导致左小腿肿胀（E对）。血栓性浅静脉炎（A错）为体表浅静脉的急性非化脓性炎症，病变静脉区呈红肿条索状，疼痛及压痛明显，局部皮肤温度升高。急性动脉栓塞（B错）（P490）起病急骤，进展迅速，主要表现为疼痛、感觉异常、麻痹、无脉和苍白。血管闭塞性脉管炎（C错）（P489）多见于青壮年男性，大多有吸烟嗜好，起病隐匿，进展缓慢，主要表现为患肢怕冷，苍白或发绀以及感觉异常。大隐静脉曲张（D错）主要表现为大隐静脉扩张、迂曲，下肢沉重与乏力感，可有踝部轻度肿胀和足靴区皮肤营养性变化（如皮肤色素沉着、皮炎、湿疹）。